女性，45岁，唇部黏膜破溃肿胀3个月余。口腔检查：下唇左侧可见一直径1cm的浅表、微凹溃疡，基底有少许渗出物，渗出物下可见桑葚样肉芽肿，溃疡边缘清楚，微隆，呈鼠噬状。根据诊断：强化治疗阶段采用的标准化疗联合用药方案是
A. 异烟肼+利福平
B. 链霉素+异烟肼+利福平
C. 链霉素+异烟肼+利福平+吡嗪酰胺
D. 异烟肼+利福平+吡嗪酰胺
E. 链霉素+异烟肼+乙胺丁醇

正确答案：C。链霉素+异烟肼+利福平+吡嗪酰胺

解析：本题考查抗结核药。45岁女性，唇部黏膜破溃肿胀3个月余。口腔检查：下唇左侧可见一直径1cm的浅表、微凹溃疡，基底有少许渗出物，渗出物下可见桑葚样肉芽肿，溃疡边缘清楚，微隆，呈鼠噬状（符合口腔结核的临床表现）。根据诊断：强化治疗阶段采用的标准化疗联合用药方案是链霉素+异烟肼+利福平+吡嗪酰胺（C对）。